汉德森-海森巴赫（Henderson-Hasselbalch）方程（HH方程）对弱有机酸药物的方程式是
A. pH-pKₐ=logfu/fi
B. pKₐ-pH=logfu/fi
C. pH-pKₐ =fu/fi
D. pH-pKₐ=fi/fu
E. pKₐ-pH=log（1-fu/fj）

正确答案：A。pH-pKₐ=logfu/fi